直径0.3～0.9cm，表面类白色，外层鳞叶2瓣，大小悬殊，习称“怀中抱月”的是
A. 松贝
B. 青贝
C. 炉贝
D. 大贝
E. 珠贝

正确答案：A。松贝

解析：本题考查的是川贝母的性状鉴别。直径0.3～0.9cm，表面类白色，外层鳞叶2瓣，大小悬殊，习称“怀中抱月”的是松贝（A对）。川贝母：【性状鉴别】药材松贝：呈类圆锥形或近球形。表面类白色。外层鳞叶2瓣，大小悬殊，大瓣紧抱小瓣，未抱部分呈新月形，习称“怀中抱月”；顶部闭合，内有类圆柱形、顶端稍尖的心芽和小鳞叶1～2枚；先端钝圆或稍尖，底部平，微凹入，中心有1灰褐色的鳞茎盘，偶有残存的须根。质硬而脆，断面白色，富粉性。气微，味微苦。青贝（B错）：呈类扁球形。外层鳞叶2瓣，大小相近，相对抱合，顶端开裂，内有心芽和小鳞叶2～3枚及细圆柱形的残茎。炉贝（C错）：呈长圆锥形。表面类白色或浅棕黄色，有的具棕色斑点。外层鳞叶2瓣，大小相近，相对抱合，顶端开裂而略尖，基部稍尖或较钝。浙贝母：【性状鉴别】药材大贝（D错）：为鳞茎外层单瓣鳞叶，略呈新月形。外表面类白色至淡黄色，内表面白色或淡棕色，被有白色粉末。质硬而脆，易折断，断面白色至黄白色，富粉性。气微，味微苦。珠贝（E错）：为完整的鳞茎，呈扁圆形。表面黄棕色至黄褐色，有不规则的皱纹；或表面类白色至淡黄色，较光滑或被有白色粉末。质硬，不易折断，断面淡黄色或类白色，略带角质状或粉性；外层鳞叶2瓣，肥厚，略呈肾形，互相抱合，内有小鳞叶2～3枚及干缩的残茎。